月经的产生，是下列哪项协调作用于胞宫的结果
A. 冲、任、督、带、天癸
B. 脏腑、气血、经络、天癸
C. 心、肝、脾、肾
D. 营卫、气血、经络、天癸
E. 胞宫、胞络、胞脉、天癸

正确答案：B。脏腑、气血、经络、天癸

解析：月经产生的机理，须运用中医学的基础理论，从脏腑、天癸、气血、冲任督带、胞宫与月经的关系进行阐述。五脏之中，肾藏精，肝藏血，脾生血，心主血，肺主气，气帅血，各司其职月经产生；天癸源于先天，藏之于肾，在肾气旺盛时期，肾中真阴不断充实，在后天水谷之精的滋养下化生并成熟泌至；冲、任、督、带脉各司其职，调节月经的产生和维持其正常生理状态；子宫主行月经，血溢子宫，月经来潮（B对）。月经的产生与各脏腑－肾、肝、脾、心、肺，天癸，冲任督带，子宫均有关系（ACE错）。营气是行于脉中而具有营养作用的气，主要是化生血液与营养全身。卫气是行于脉外而具有保护作用的气，主要是防御外邪，温养全身和调控腠理的生理作用。二者与月经的产生无直接作用（D错）。